女，38岁。餐后上腹疼痛2年。经服用西咪替丁可缓解，症状反复出现，至医院就诊。胃镜发现胃小弯侧溃疡性病变，病理证实良性。患者行胃大部切除术后第6天。胃管内流出咖啡色胃液300ml，最可能是因为
A. 吻合口感染
B. 吻合口漏
C. 术后正常出血
D. 术中止血不确切
E. 吻合口部分黏膜坏死脱落

正确答案：E。吻合口部分黏膜坏死脱落

解析：行胃大部切除的患者手术后出现胃出血，发生在24小时之内的多因手术中残留或者缝合创面少量渗血所致（C错），如果发生在术后4～6天，一般为吻合口部分黏膜坏死脱落引起（E对），如果发生在术后10～20天，一般为吻合口缝线感染（A错），粘膜下脓肿腐蚀血管所致。吻合口漏（B错）、术中止血不确切（D错）一般见于腹腔内出血，引流管一般可见较多新鲜血。